引起舌乳头萎缩的最常见原因是
A. 药物过敏
B. 病毒感染
C. 局部创伤
D. 慢性咽炎
E. 维生素B₂缺乏

正确答案：E。维生素B₂缺乏

解析：本题考查萎缩性舌炎的病因。引起舌乳头萎缩的最常见原因是维生素B₂缺乏（E对）。引起舌乳头萎缩的病因有：1.贫血：因维生素B₁₂、维生素B₆、叶酸缺乏导致的正色素性大细胞贫血等；2.烟酸、维生素B₂缺乏；3.干燥综合征；4.念珠菌感染（B错）；5.其他疾病：地图舌、萎缩型扁平苔藓、口腔黏膜下纤维性变、红斑等。药物过敏常引起药物过敏性口炎或固定性药疹等（A错）。局部创伤常引起黏膜或舌缘处的创伤性溃疡（C错）。慢性咽炎多表现为咽部不适、有异物感、灼烧微痛等（D错）。